种植体周围的结缔组织与天然牙相似，高度为
A. 1-2mm
B. 1-3mm
C. 2-3mm
D. 0-2mm
E. 0-1mm

正确答案：A。1-2mm

解析：种植体周围的结缔组织与天然牙相似，高度为1-2mm。掌握“种植体周围组织”知识点。